发作性吸气性呼吸困难，临床最常见于
A. 气胸
B. 气管内异物
C. 急性支气管炎
D. 急性心肌梗死
E. 慢性阻塞性肺疾病

正确答案：B。气管内异物

解析：吸气性呼吸困难表现为吸气显著费力，严重者吸气时可见“三凹征”，表现为胸骨上窝、锁骨上窝和肋间隙明显凹陷，此时亦可伴有干咳和高调性喉鸣。三凹征的出现主要是由于呼吸肌极度费力，胸腔负压增加所致，常见于气道狭窄与阻塞（B对）。由于胸腔内积气引起肺呼吸面积减少导致换气功能障碍，因而气胸（A错）引起的呼吸困难属于混合性呼吸困难。急性支气管炎（C错）是由病毒、细菌等病原体感染所致的支气管黏膜炎症，疾病多累及气管、支气管，一般不诱发呼吸困难，继发气道阻塞时可引起吸气性呼吸困难。急性心肌梗死（D错）引起心力衰竭时引起的呼吸困难属于心源性呼吸困难。慢性阻塞性肺疾病（E错）是由吸烟等多种病因联合所致的肺泡弹性降低或小气管炎症，因而其导致的呼吸困难属于呼气性呼吸困难。